老年人最常见的硬脊膜外肿瘤是
A. 脊膜瘤
B. 淋巴瘤
C. 转移瘤
D. 胶质瘤
E. 脊索瘤

正确答案：C。转移瘤

解析：根据肿瘤与脊髓、硬脊膜的关系，椎管内肿瘤可分为硬脊膜外肿瘤、髓外硬脊膜下肿瘤和髓内肿瘤三大类。硬脊膜外肿瘤以转移瘤（C对）最常见，脊膜瘤（A错）、脊索瘤（E错）、神经鞘瘤、表皮样囊肿、脂肪瘤、肉瘤等较少见。胶质瘤（D错）指来源于神经胶质细胞和神经元细胞的颅内肿瘤，是最常见的颅内肿瘤。淋巴瘤（B错）是椎管内肿瘤中较少见的病理类型，在硬脊膜肿瘤中的发病率更低。